硫脲类抗甲状腺药引起的严重不良反应是
A. 再生障碍性贫血
B. 低蛋白血症
C. 心动过速
D. 粒细胞缺乏症
E. 粘液性水肿

正确答案：D。粒细胞缺乏症